处方开具的药物，一般不得超过的用量是
A. 10日用量
B. 7日用量
C. 5日用量
D. 3日用量
E. 1日用量

正确答案：B。7日用量

解析：处方开具的药物，一般不得超过的用量是7日用量（B对）。